睾丸(卵巢)动脉来自于
A. 腹腔动脉
B. 骼总动脉
C. 腹主动脉
D. 腰动脉
E. 髂内动脉

正确答案：C。腹主动脉

解析：腹主动脉（C对）为睾丸动脉或卵巢动脉的起始部位，睾丸动脉又称精索内动脉，分布于睾丸和附睾，在女性对应的动脉为卵巢动脉。